感染性结石的性质是
A. 草酸盐结石
B. 尿酸结石
C. 混合型结石
D. 碳酸盐结石
E. 磷酸盐结石

正确答案：E。磷酸盐结石

解析：感染性结石指与尿路感染有关的结石，其主要成分为六水磷酸镁铵、磷酸钙。变形杆菌、绿脓杆菌等引起尿路感染的细菌含有产脲酶，可分解尿素使尿液呈强碱性，导致磷酸盐析出，从而形成磷酸盐结石（E对）即感染性结石。草酸盐结石（A错）多由内源性草酸合成增加或肠道吸收草酸增加形成的高草酸血症导致。尿酸结石（B错）与尿酸代谢异常有关，常见于进食过多含嘌呤食物者、痛风、部分恶性肿瘤患者等。混合型结石（C错）成分复杂，形成原因亦各有不同。碳酸盐结石（D错）亦和尿液碱化有关，但不如磷酸盐结石常见。